男，65岁。排便次数增加6个月，伴里急后重、排便不尽感。1个月来大便变细，偶有大便表面带血，自觉乏力，体重减轻4Kg。首选的检查方法是
A. 粪隐血
B. 直肠指检
C. 腹部超声
D. 结肠镜
E. 腹部CT

正确答案：B。直肠指检

解析：老年男性患者，排便次数增加6个月，伴里急后重、排便不尽感（直肠刺激症状）。1个月来大便变细，偶有大便表面带血，自觉乏力，体重减轻4Kg。综合患者的症状、体征，初步诊断为直肠癌。直肠癌首选检查为直肠指检（B对），指诊可查出肿瘤部位，距肛缘的距离，肿瘤的大小、范围等。结肠镜检+活检为直肠癌确诊的检查，但不是首选检查（D错）。粪隐血为大规模人群结、直肠癌的初筛手段（A错）。腹部超声（C错）、腹部CT（E错）可以了解直肠癌的转移情况，为术前常用的检查方法。